上颌第一双尖牙形态中哪一点是错误的
A. 可见近中沟
B. 颊面五边形
C. 颊尖偏近中
D. 颊侧宽于舌侧
E. （牙合）面六边形

正确答案：C。颊尖偏近中

解析：本题考查上颌第一双尖牙的形态特点。颊尖偏近中（C错，为本题正确答案）不符合上颌第一双尖牙的形态特点。上颌第一双尖牙是前磨牙中唯一的颊尖偏向远中者。颊面与尖牙唇面相似为五边形（B对），但牙冠较短小。舌面较颊面小（D对），似卵圆形。牙合面外形为明显的六边形（E对），可见近中沟（A对）由近中点隙发出越过近中边缘嵴至近中面，是上颌第一双尖牙的特有解剖标志。